处方调配程序中第四项工作是
A. 收方
B. 调配
C. 划价
D. 核查
E. 发药

正确答案：A。收方